引起痈的病原体常见
A. 金葡菌
B. 链球菌
C. 大肠杆菌
D. 绿脓杆菌
E. 疱疹病毒

正确答案：A。金葡菌

解析：痈指邻近的多个毛囊及其周围组织的急性化脓性感染，病原菌以金黄葡萄球菌为主。掌握“软组织急性感染”知识点。